男，体温高，心率快，血压80/50mmHg，神智不清。Hb103g/L，白细胞20×10⁹/L，中性粒细胞高。治疗方法错误的是
A. 补液抗休克
B. 输入抗生素抗感染治疗
C. 物理降温
D. 输白蛋白
E. 输血抗休克

正确答案：E。输血抗休克

解析：患者男，出现体温高（C对），心率快，血压80/50mmHg（正常血压120/80 mmHg，出现休克征象）（A对），神智不清。Hb103g/L（正常血红蛋白120-160g/L，低于正常值）（D对），白细胞20×10⁹/L（正常白细胞4～10×10⁹/L，白细胞增高），中性粒细胞高（细菌感染早期）（B对），结合患者的表现，可诊断为细菌感染导致的急性休克，应给予补液抗休克、抗生素抗感染治疗、物理降温、输白蛋白等对症治疗，该患者为感染性休克，补充血容量以输注平衡盐溶液为主（E错，为本题正确答案）。